可以减轻环磷酰胺导致的膀胱毒性的药物是
A. 亚叶酸钙
B. 美司钠
C. 二硫基丙醇
D. 右雷佐生
E. 硫代硫酸钠

正确答案：B。美司钠

解析：本题考查美司钠。环磷酰胺可出现出血性膀胱炎，尤其在大剂量给药和既往接受盆腔放疗的患者易发生，可预防性给予美司钠（B对）。亚叶酸钙（A错）用于大剂量甲氨蝶呤的解毒治疗。二硫基丙醇（C错）用于治疗金属中毒。右雷佐生（D错）可用于减轻或减少蒽环类抗生素(如多柔比星）化疗引起的心肌毒性。硫代硫酸钠（E错）临床用于治疗皮肤瘙痒症、荨麻疹、药疹、氰化物、铊中毒和砷中毒等。